格列齐特片的适宜服药时间是
A. 清晨
B. 餐前
C. 餐中
D. 餐后
E. 睡前

正确答案：B。餐前

解析：本题考查药品服用的适宜时间。格列齐特片的适宜服药时间是餐前（B对）。格列齐特为磺酰脲类促胰岛素分泌药，餐前服药疗效较好，血浆达峰时间比餐中服用提早。适宜清晨（A错）服用的药物有抗高血压药物、抗抑郁药、利尿药等。适宜餐中（C错）服用的药物有助消化药、肝胆辅助用药、减肥药、抗结核药等。适宜餐后（D错）服用的药物有非甾体抗炎药、维生素、组胺H₂受体阻断剂。适宜睡前（E错）服用的药物有催眠药、平喘药、钙剂、缓泻药等。